IgG的生物学作用之一是
A. 与Ag结合后激活补体
B. 不能透过胎盘
C. 与Ag位作用后，体内最先出现
D. 是分泌液中主要的保护性抗体
E. 其Fc段可以与肥大细胞结合

正确答案：A。与Ag结合后激活补体

解析：IgG的特性和功能：IgG是血清中含量最高的Ig，血清半衰期约23天，以单体形式存在。IgG是唯一能够通过胎盘进入胎儿体内的Ig，对防止新生儿感染具有重要意义。婴儿出生后3个月开始合成IgG，3～5岁时合成Ig的能力和成人相近，40岁后此能力逐渐下降。IgG1～3能通过经典途径活化补体，能调理吞噬，介导ADCC。掌握“各类球蛋白的特性和功能”知识点。